我国规定的儿童基础免疫的生物制品中包括
A. 乙脑疫苗
B. 流脑多糖体菌苗
C. 麻疹疫苗
D. 伤寒菌苗
E. 钩端螺旋体菌苗

正确答案：C。麻疹疫苗